男婴，3天。黄疸2天，加重伴嗜睡1天，无发热及惊厥。足月儿，出生体重3560g。查体：T35.0℃。吮吸无力，反应差，全身皮肤及巩膜明显黄染。心肺未见明显异常，腹软，肝肋下2cm，实验室检查：Hb90g/L，血清总胆血红素425μmol/L。最可能的诊断是
A. 先天性胆道闭锁
B. 生理性黄疸
C. 新生儿溶血病
D. 母乳性黄疸
E. 新生儿肝炎

正确答案：C。新生儿溶血病

解析：患儿出生3天，黄疸2天，加重伴嗜睡（Rh溶血病患儿生后24小时内出现黄疸病迅速加重），Hb90g/L（出生2周内血红蛋白＜130g/L即为新生儿贫血），血清总胆血红素425μmol/L（正常值＜221μmol/L），查体肝肋下2cm，提示肝脾肿大，根据患儿症状体征考虑诊断为新生儿溶血病（C对）。先天性胆道闭锁（A错）常常与生后24小时出现黄疸，且较重，以直接胆红素升高为主。通常认为，足月儿＜221μmol/L（12.9mg/dl），早产儿＜256μmol/L（15mg/dl）是生理性的，而该患儿血清总胆血红素425μmol/L大于正常值，因此不能诊断为生理性黄疸（B错）。母乳性黄疸（D错）是指母乳喂养的新生儿在生后3个月内仍有黄疸，而该患儿出生仅有3天，因此还不能诊断为母乳性黄疸。新生儿肝炎（E错）在围生期一般有宫内感染的病史，胎儿出生后有明显肝功能损害的临床表现，因此不能诊断为新生儿肝炎。